牙周炎的组织破坏特点
A. 缓慢性破坏
B. 持续性破坏
C. 进行性破坏
D. 渐进性破坏
E. 破坏活动期与静止期交替发生

正确答案：E。破坏活动期与静止期交替发生

解析：本题考查牙周病的活动性。牙周炎的组织破坏特点为破坏活动期与静止期交替发生（E对）。不是缓慢性（A错）、持续性（B错）、进行性（C错）、渐进性破坏（D错）。静止期的特征是炎症反应轻，没有或很少有骨和结缔组织的附着丧失。当以G⁻厌氧菌为主构成的非附着菌斑增厚，则开始了骨和结缔组织附着丧失以及牙周袋加深的加重期，也称活动期。此期可持续数天、数月或数年。此后，常可自动进入静止期，主要致病菌减少或消失，病变稳定。